下颌下腺导管切开取石术后多久可行腺体切除术
A. 4个月
B. 5个月
C. 6个月
D. 7个月
E. 8个月

正确答案：C。6个月

解析：腺体切除术：适用于涎石位于下颌下腺内或下颌下腺导管后部、腺门部的涎石。下颌下腺反复感染或继发慢性硬化性下颌下腺炎、腺体萎缩，已失去摄取及分泌功能者。下颌下腺导管切开取石术后6个月，行99mTc下颌下腺功能测定，功能明显低下者，结合临床表现，亦可考虑行腺体切除术。掌握“涎石病及下颌下腺炎”知识点。